260.27）采用溴量法测定含量时,每1ml滴定液（0.1mol/L）相当于司可巴比妥钠的毫克数（mg）为
A. 1.301
B. 2.601
C. 13.01
D. 26.01
E. 18.01

正确答案：C。13.01